形成附睾体的是
A. 精曲小管
B. 精直小管
C. 睾丸网
D. 睾丸输出小管
E. 附睾管

正确答案：E。附睾管

解析：附睾管（E对）迂曲盘回形成附睾体。